慢性肾小球肾炎患者，当蛋白尿大于1g/天时，血压控制的理想水平是
A. 120/80mmHg以下
B. 125/75mmHg以下
C. 130/80mmHg以下
D. 140/90mmHg以下
E. 135/85mmHg以下

正确答案：B。125/75mmHg以下

解析：慢性肾小球肾炎应根据肾活检病理类型进行针对性治疗，因慢性肾炎呈持续进行性进展，最终发展至终末期肾衰竭，控制高血压特别是肾内毛细血管高血压是延缓慢性肾衰竭进展的重要措施。目前多数学者认为，肾病患者的血压应较一般高血压患者控制更为严格，尿蛋白≥1g/24h，血压应控制在125/75mmHg（B对）；如果尿蛋白≤1g/24h，血压控制可放宽到130/80mmHg以下，同时应该尽量选用具有肾脏保护作用的降压药（ACEI或ARB）。该数据在九版内科学中有更新。